输血最常见的并发症是
A. 凝血
B. 溶血
C. 发热
D. 出血
E. 栓塞

正确答案：C。发热

解析：输血过程中由于致热原的影响较易产生非溶血性发热性输血反应，是输血最常见的并发症（C对）。凝血（A错）不是输血并发症。溶血（B错）是指输入的红细胞在受血者的体内发生异常破坏引起的不良反应称溶血性输血反应，是最严重的输血并发症。出血（D错）、栓塞（E错）不属于输血并发症。